评价筛检试验真实性的指标有
A. 灵敏度、阳性预测值、可靠性
B. 特异度、阴性预测值、可重复性
C. 灵敏度、特异度、约登指数
D. 变异性、灵敏度、假阳性率
E. 一致性、约登指数、假阳性率

正确答案：C。灵敏度、特异度、约登指数